延髓中与脑神经相关的核团是
A. 孤束核
B. 上泌涎核
C. 薄束核
D. 楔束核
E. 下橄榄核

正确答案：A。孤束核

解析：延髓中与脑神经相关的核团是孤束核（A对），上泌涎核（B错）位于脑桥。薄束核（C错）、楔束核（D错）是传递躯干四肢意识性本体感觉和精细触觉冲动的中继核团，不与脑神经相连。下橄榄核（E错）广泛接受脊髓全长的上行投射纤维和脑干感觉性中继核团的传入纤维，而后与脊髓小脑后束等共同组成小脑下脚，进入小脑，参与小脑对运动的调控，下橄榄核也不与脑神经相连。